被誉为传播学的经典的传播模式是
A. 马斯洛多向传播
B. 施拉姆双向传播
C. 拉斯韦尔五因素
D. 华生七因素
E. 格林互动传播

正确答案：C。拉斯韦尔五因素